在火器伤中能够造成人体组织形成比原发伤道直径大数倍甚至数十倍损伤的作用力
A. 前冲力
B. 侧冲力
C. 空气阻力
D. 爆炸力
E. 冲击力

正确答案：B。侧冲力

解析：火器伤致伤来源有两种作用力：一种前冲力，而是侧冲力，侧冲力与伤道垂直并以压力波的形式向四周扩散，是组织形成比原发伤道直径大数倍甚至数十倍的瞬时空腔，可造成四周软组织和骨的损伤。掌握“火器伤、热烧伤”知识点。